特殊毒性不包括
A. 致突变
B. 急性毒性
C. 致癌
D. 致畸
E. 生殖毒性

正确答案：B。急性毒性